开展医院感染的流行病学调查常用方法不包括
A. 现况调查
B. 随机对照试验
C. 病例对照研究
D. 队列研究
E. 现场干预研究

正确答案：B。随机对照试验